治疗小儿风寒咳嗽，应首选
A. 桑菊饮
B. 清宁散
C. 桑杏汤
D. 杏苏散
E. 桑白皮汤

正确答案：D。杏苏散

解析：咳嗽是小儿常见的一种肺系病证，有声无痰为咳，有痰无声为嗽，风夹寒邪，风寒束肺，肺气失宣，则见咳嗽频作，治以杏苏散，可疏风散寒，宣肃肺气（D对）。桑菊饮适于风热咳嗽，症见咳嗽不爽，痰黄黏稠（A错）。清宁散主治小儿心肺蕴热发惊，甚则搐掣，咳嗽（B错）。桑杏汤善于治疗外感温燥证，症见咽干鼻燥，干咳无痰，或痰少而黏，舌红，苔薄白而干（C错）。桑白皮汤善治肺经热甚，喘嗽痰多等实证（E错）。